牙周炎在X线片上牙槽骨吸收的最主要表现是
A. 牙槽骨高度降低
B. 牙槽骨密度增强
C. 根尖区骨密度减低阴影
D. 牙周膜宽度均匀增加
E. 牙槽嵴顶位于釉牙骨质界下1mm

正确答案：A。牙槽骨高度降低

解析：本题考查牙槽骨吸收的X线表现。牙周炎在X线片上牙槽骨吸收的最主要表现是牙槽骨高度降低（A对）。患牙周炎时，由于牙槽骨的破坏，硬骨板常不完整或消失，硬骨板的表现一定程度上可以反映出疾病的变化，在疾病治疗前或活动期，硬骨板往往消失；待牙周治疗后，硬骨板则重新形成，且呈致密连续影；对于维护期的患者和牙位应该定期复查拍摄X线片，通过观察硬骨板的变化可以间接判断病情的恢复情况及稳定性。牙槽骨吸收的X线表现是：牙槽骨密度减低（B错），或呈虫蚀状，牙槽骨高度降低。X线片上牙槽骨吸收发生的部位在牙槽嵴顶，不在根尖区，所以不会出现根尖区骨密度减低阴影（C错）。患牙周炎时牙周膜宽度会相应显示增宽或明显增宽，但这种牙周膜宽度的增加是不均匀增加（D错），一般牙冠侧增宽幅度大。因X线片主要显示牙齿近远中的骨质情况，而颊舌侧牙槽骨因与牙齿重叠而显示不清晰，在标准根尖片上，牙槽嵴顶到釉牙骨质界的距离超过2mm，亦即牙槽嵴顶位于釉牙骨质界下2mm（E错）即可认为有牙槽骨吸收。